患者，男，65岁。陈旧性心肌梗死病史，近日劳累后心悸、气短、动则加剧，神疲，怕冷，四肢不温，舌淡有齿痕，脉沉细。治疗应首先考虑的方剂是
A. 葶苈大枣泻肺汤
B. 苓桂术甘汤
C. 生脉散
D. 真武汤
E. 养心汤合补肺汤

正确答案：D。真武汤

解析：患者有陈旧性心肌梗死病史，阳虚不能化水，水邪内停，上凌于心，故见心悸、气短咳喘；气虚则见乏力、动则加剧，神疲；怕冷，四肢不温，舌淡有齿痕，脉沉细，是阳虚水泛的表现；治法为温阳利水，通脉止痛，方药选用真武汤（D对）。葶苈大枣泻肺汤（A错）可以泻肺利水，降逆平喘，用于治疗水饮停肺证。苓桂术甘汤（B错）可以温阳化饮，健脾利湿，用于治疗中阳不足之痰饮病。生脉散（C错）可以益气养阴，敛汗生脉，用于治疗心肌梗死气阴两伤证。养心汤合补肺汤（E错）可以益气补肺，补血养心，用于治疗心肺气血两虚证。